下列哪种黏合剂是家居环境中酚和甲醛污染的主要来源
A. 环境树脂
B. 酚醛树脂
C. 聚氨酯
D. 脲醛树脂
E. 氯丁橡胶

正确答案：B。酚醛树脂

解析：本题考查家居环境中酚和甲醛污染的主要来源。酚醛树脂黏合剂（B对ACDE错）是家居环境中酚和甲醛污染的主要来源。其主要危害是刺激与致敏作用，如皮肤瘙痒、变应性皮炎、结膜及角膜刺激灼伤引起流泪、产生臭味等。